患者女性32岁，自诉“胆小怕痛”曾有“晕针史”。检查见残根，根尖瘘管挤压无脓，治疗设计为局麻下拔除，麻醉顺利，12分钟后试麻效良好，开始操作，术中患者觉疼痛但可耐受，其后自诉头晕，胸闷，心慌，恶心，检查患者面色苍白，四肢冷而无力，脉快而弱。此时患者出现的症状是晕厥。此情形的处理，下列哪项是不必要的
A. 立即停止手术，保持呼吸道通畅
B. 输液，纠正代谢紊乱
C. 必要时静脉推注高渗葡萄糖
D. 嗅闻刺激性气体
E. 吸氧

正确答案：B。输液，纠正代谢紊乱

解析：本题考查局麻的并发症-晕厥的防治措施。晕厥是一时的中枢性缺血所致的突发性、暂时性意识丧失，多由恐惧、疲劳、饥饿或身体状况差所致，而非酸碱平衡紊乱，故输液纠代谢紊乱（B错，为本题的正确答案）是不必要的。晕厥时的正确处理为：立即停止手术，松解衣领，保持呼吸道通畅（A对），维持呼吸；嗅闻刺激性气体（D对），刺激患者呼吸；必要时静脉推注高渗葡萄糖（C对），吸氧（E对），有助于加快患者恢复意识。